肿瘤细胞分化程度高是指
A. 肿瘤周围有较多的淋巴细胞浸润
B. 不容易引起器官的阻塞和破坏
C. 高度恶性的肿瘤
D. 有较大的异型性
E. 与起源组织相似

正确答案：E。与起源组织相似

解析：肿瘤细胞的分化程度是指肿瘤组织在形态和功能上与其起源组织的相似程度，分化程度越高，与起源组织越相似（E对）。而高度恶性的肿瘤（C错）和有较大的异型性（D错）的肿瘤，肿瘤细胞的分化程度均较低。